以下不属于人为事故的是
A. 生物恐怖
B. 校园火灾
C. 毒气泄漏
D. 瓦斯爆炸
E. 流行性感冒

正确答案：E。流行性感冒

解析：本题考查人为事故。流行性感冒（E错，为本题正确答案）属于公共卫生事件，公共卫生事件是指突然发生，造成或者可能造成社会公众健康严重损害的重大传染病疫情、群体性不明原因疾病、重大食物和职业中毒以及其他严重影响公众健康的事件。生物恐怖（A对）、校园火灾（B对）、毒气泄漏（C对）和瓦斯爆炸（D对）均属于人为事故。